浅龋与氟斑牙相鉴别的重要参考因素是
A. 牙齿的色泽改变
B. 有无牙体组织缺损
C. 病变牙位的多少
D. 地区流行情况
E. 对温度反应情况

正确答案：D。地区流行情况

解析：浅龋的鉴别诊断：氟牙症氟牙症又称斑釉症，是一种特殊类型的釉质发育不全。受损牙面呈白垩色至深褐色，对称性分布。在牙齿发育矿化期有在高氟区生活的历史。掌握“龋病的诊断及鉴别诊断”知识点。